某女，36岁。胃脘胀痛，连及胁肋，善太息，生气后症状加重，食欲不振；舌质红，苔薄白，脉弦。应选用的方剂是
A. 左金丸加减
B. 良附丸加减
C. 保和丸加减
D. 柴胡疏肝散加减
E. 黄芪建中汤加减

正确答案：D。柴胡疏肝散加减

解析：本题考查的是胃痛的辨证论治。胃脘胀痛，连及胁肋，善太息，生气后症状加重，食欲不振；舌质红，苔薄白，脉弦。应选用的方剂是柴胡疏肝散加减（D对）。胃痛又称胃脘痛，是以上腹胃脘部近心窝处疼痛为主要表现的疾病。西医学的胃炎、消化性溃疡、功能性消化不良等疾病以上腹部疼痛为主要表现者，可参考此内容辨证论治。（一）寒邪客胃证：【症状】胃痛暴作，喜温恶寒，得温痛减，口和不渴，或喜热饮。舌淡，苔薄白，脉弦紧。【方剂应用】基础方剂为良附丸（高良姜、香附）加减（B错）。（二）饮食伤胃证：【症状】胃脘疼痛，胀满拒按，嗳腐恶食，或吐不消化食物，吐后或矢气后痛减，大便不爽。舌淡红，苔厚腻，脉滑。【方剂应用】基础方剂为保和丸（山楂、神曲、茯苓、半夏、莱菔子、陈皮、连翘、麦芽）加减（C错）。（三）肝气犯胃证：【症状】胃脘胀痛，痛连两胁，遇烦恼则痛作或痛甚，嗳气、矢气则舒，脘闷嗳气，善太息，大便不畅。舌淡红，苔薄白，脉弦。【方剂应用】基础方剂为柴胡疏肝散（柴胡、香附、枳壳、芍药、陈皮、川芎、炙甘草）加减。（四）湿热中阻证：【症状】胃脘疼痛，痛势急迫，脘闷灼热，口干口苦，口渴不欲饮，纳呆恶心，小便色黄，大便不畅。舌红，苔黄腻，脉滑数。【方剂应用】基础方剂为清中汤（黄连、栀子、半夏、茯苓、陈皮、草豆蔻、甘草）加减。（五）胃阴亏耗证：【症状】胃脘隐隐灼痛，似饥而不欲食，口干咽燥，口渴思饮，五心烦热，消瘦乏力，大便干结。舌红少津，脉细数。【方剂应用】基础方剂为一贯煎（沙参、麦冬、当归、生地黄、枸杞子、川楝子）合芍药甘草汤（芍药、甘草）加减。（六）脾胃虚寒证：【症状】胃痛隐隐，绵绵不休，喜温喜按，空腹痛甚，得食痛缓，劳累或受凉后发作或加重，时呕清水，神疲纳少，四肢倦怠，手足不温，大便溏薄。舌淡苔白，脉虚弱或迟缓。【方剂应用】基础方剂为黄芪建中汤（炙黄芪、桂枝、生姜、芍药、炙甘草、大枣、饴糖）加减（E错）。方剂应用为左金丸加减（A错）的病证，2022年考试指南未明确说明。左金丸：【功能】泻火，疏肝，和胃，止痛。【主治】肝火犯胃，脘胁疼痛，口苦嘈杂，呕吐酸水，不喜热饮。